女，65岁。右侧胸部闭合性损伤2天。右胸疼痛，咳嗽时加重，无呼吸困难。胸壁皮肤无破损，局部皮下淤血。胸部X线片示右侧第6肋骨单处骨折，右侧气胸压缩40%。最可能的原因是
A. 闭合性气胸
B. 急性胸膜炎
C. 张力性气胸
D. 开放性气胸
E. 连枷胸

正确答案：A。闭合性气胸

解析：老年患者，右侧胸部闭合性损伤2天，右胸痛，咳嗽时加重，无呼吸困难，胸部皮肤无破损，局部皮下淤血，胸部X线片示右侧第6肋骨单处骨折，右侧气胸压缩40%，根据患者的临床症状、体征及实验室检查考虑最可能的诊断为闭合性气胸（A对），张力性气胸（C错）病人表现为极度或严重的呼吸困难、烦躁、意识障碍、大汗淋漓、发绀，肺部严重萎陷。开放性气胸（D错）胸壁有开放性伤口，该患者胸部皮肤无破损。连枷胸（E错）是指在两根以上相邻肋骨各自发生2处或以上骨折时，在自主呼吸时出现反常运动，即吸气时软化区胸壁内陷，呼气时相对外突，导致伤员出现低通气状态，甚至诱发呼吸衰竭。